药剂学配伍变化中，属于物理变化的是
A. 爆炸
B. 变色
C. 产气
D. 聚合
E. 潮解

正确答案：E。潮解

解析：本题考查的是物理配伍变化。药剂学配伍变化中，属于物理变化的是潮解（E对）。物理配伍变化包括：溶解度的改变，吸湿、潮解、液化与结块，粒径或分散状态的改变。化学配伍变化包括：产生浑浊或沉淀，产生有毒物质，变色（B错）与产气（C错），发生爆炸（A错）。其中变色制剂配伍发生氧化、还原、聚合（D错）、分解等反应时，可引起颜色的改变。